支气管肺炎与支气管炎的主要区别点是
A. 发热、频咳
B. 气促、喘憋
C. 呼吸音减弱
D. 肺部可闻固定湿罗音
E. 白细胞增高

正确答案：D。肺部可闻固定湿罗音

解析：支气管肺炎肺部可闻及固定中细湿罗音，急性支气管炎肺部可闻及干湿罗音，多不固定，随咳嗽而改变（D对）。发热、频咳（A错），气促、喘憋 （B错），白细胞增高（E错）均可见于支气管肺炎与支气管炎。支气管肺炎与支气管炎一般均无呼吸音减弱（C错）。